除垫底材料以外，以下药物可以减小牙本质小管的渗透性的是
A. 草酸钾
B. 磷酸
C. 酒精
D. 草酸
E. 硝酸甘油

正确答案：A。草酸钾

解析：本题考查牙本质渗透性。某些修复材料(洞底)如草酸钾（A对）和氢氧化钙可减少被切割的牙本质小管的渗透性。牙本质小管具有渗透性。液体可通过小管自牙髓达釉牙本质界。在牙釉质损伤时一些液体也可由釉牙本质界达牙髓。细菌产物如内毒素可进入牙本质小管并引起炎症反应。此时牙髓血管的渗透性增加，增加的牙髓内压及牙本质内液的形成有利于小管的清洁并阻止细菌进入牙髓。由于硬化或修复性材料所致的牙本质小管管径缩小，也可减少牙本质的渗透性。垫底材料也可能封闭牙本质小管。牙本质液的形成可影响修复材料与牙本质的结合。修复材料或牙本质硬化可减轻牙本质的渗透性和敏感性。